救治乙醇中毒的措施，正确的有
A. 单纯急性轻度乙醇中毒不需治疗，居家观察，嘱其保暖，防治呕吐物误吸
B. 催吐，洗胃和活性炭不适用于单纯性乙醇中毒
C. 急性乙醇中毒者，肌内或静脉注射阿扑吗啡
D. 急性乙醇中毒者，肌内或静脉注射纳洛酮
E. 严重乙醇中毒者，静脉注射50%葡萄糖注射液，胰岛素，同时肌内注射维生素B₁，维生素B₆

正确答案：A、B、D、E。单纯急性轻度乙醇中毒不需治疗，居家观察，嘱其保暖，防治呕吐物误吸；催吐，洗胃和活性炭不适用于单纯性乙醇中毒；急性乙醇中毒者，肌内或静脉注射纳洛酮；严重乙醇中毒者，静脉注射50%葡萄糖注射液，胰岛素，同时肌内注射维生素B₁，维生素B₆

解析：本题考查乙醇中毒解救。救治乙醇中毒的措施：单纯急性轻度酒精中毒不需治疗，居家观察，有肥胖通气不良等基础疾病要嘱其保暖、侧卧位防止呕吐误吸（A对）等并发症。由于酒精吸收迅速，催吐、洗胃和活性炭不适用于单纯酒精中毒患者（B对）。严重乙醇中毒者，静脉注射50%葡萄糖注射液，胰岛素，同时肌内注射维生素B₁，维生素B₆（E对）及烟酸各100mg，以加速乙醇在体内氧化，促进清醒。纳洛酮（D对）能解除酒精中毒的中枢抑制，并能促进乙醇在体内转化，缩短昏迷时间，有催醒作用。肌内或静脉注射阿扑吗啡（C错）会加重急性酒精中毒者的症状。